ETEC可产生的两种肠毒素是
A. LT肠毒素和ST肠毒素
B. LT肠毒素和RT肠毒素
C. LT肠毒素和S肠毒素
D. ST肠毒素和S肠毒素
E. ST肠毒素和VT肠毒素

正确答案：A。LT肠毒素和ST肠毒素

解析：ETEC分泌不耐热肠毒素（LT）和耐热肠毒素（ST），导致小肠黏膜对水分吸收功能障碍。掌握“肠道杆菌共性及埃希氏菌属”知识点。